具有利水通淋功效的药物是
A. 川芎
B. 丹参
C. 郁金
D. 桃仁
E. 牛膝

正确答案：E。牛膝

解析：该题考查牛膝的功效，属记忆内容。选项均为活血药，都有活血的功效。牛膝味苦、甘、酸，性平；入肝、肾经；具有活血通经，补肝肾，强筋骨，利水通淋（E对），引火（血）下行的功效。